某外科医师善治疮肿瘰疬、乳腺增生等，常用中成药小金丸（糊丸），用后每能收效。该药处方有人工麝香，木鳖子（去壳去油）、制草乌、枫香脂，醋乳香，醋没药，五灵脂（醋炒）、酒当归、地龙、香墨等，功能散结消肿，化瘀止痛，主治痰气凝滞所致的瘰疬、乳岩、乳癖。症见肌肤或肌肤下肿块一处或数处，推之能动或骨及骨关节肿大，皮色不变、肿硬作痛。关于糊丸剂型特点和质量要求的说法，错误的是
A. 糊丸含水量不得过9.0%
B. 糊丸按肠溶衣片崩解时限检查法检查，应符合规定
C. 糊丸溶散迟缓，可延长药效
D. 糊丸可降低处方中有毒饮片的毒性
E. 糊丸可缓解药物对胃肠道的刺激性

正确答案：B。糊丸按肠溶衣片崩解时限检查法检查，应符合规定

解析：本题考查的是糊丸剂型特点和质量要求。糊丸应在2小时内全部溶解，无需按肠溶衣片崩解时限检查法检查（B错，为本题正确答案）。丸剂的溶散时限：除另有规定外，小蜜丸、水蜜丸和水丸应在1小时内全部溶散；浓缩丸和糊丸应在2小时内全部溶散；滴丸应在30分钟内全部溶散，包衣滴丸应在1小时内全部溶散。蜡丸照崩解时限检查法片剂项下的肠溶衣片检查法检查，在盐酸溶液中（9→1000）检查2小时，不得有裂缝、崩解或软化现象，再在磷酸盐缓冲液（pH6.8）中检查，1小时内应全部崩解。除另有规定外，大蜜丸及研碎、嚼碎后或用开水、黄酒等分散后服用的丸剂不检查溶散时限。糊丸系指饮片细粉以米糊或面糊等为黏合剂制成的丸剂。糊丸的特点：①溶解迟缓，释药缓慢，“取其迟化”可延长药效（C对）。②减少药物对胃肠道的刺激性（E对）。含毒性或刺激性饮片（D对）以及需延缓药效的方药，可制成糊丸。除另有规定外，糊丸中所含水分不得超过9.0%（A对）。